肝藏血的生理功能是指肝
A. 贮藏血液
B. 调节血量
C. 统摄血液
D. 贮藏血液和调节血量
E. 化生血液与统摄血液

正确答案：D。贮藏血液和调节血量

解析：肝主藏血是指肝有贮藏血液（A错）、防止出血和调节血量（B错）的功能（D对）。化生血液与统摄血液（C错）为脾的功能（E错）。